影响伤口愈合最常见的局部因素是
A. 局部血运障碍
B. 创面范围大
C. 感染
D. 异物清除不彻底
E. 年龄

正确答案：C。感染

解析：感染通常为影响伤口愈合最常见的局部因素（C对）；全身因素主要有营养不良、大量使用细胞增生抑制剂、免疫功能低下及全身性严重并发症。局部血运障碍（A错）、创面范围大（B错）、异物清除不彻底（D错）、年龄（E错）均不是影响伤口愈合最常见的局部因素。